起于足跟内侧的经脉是
A. 阳跷脉
B. 阴跷脉
C. 阴维脉
D. 阳维脉
E. 冲脉

正确答案：B。阴跷脉

解析：阳跷脉起于足跟外侧（A错）。阴跷脉起于足跟内侧（B对）。阴维脉起于小腿内侧（C错）。阳维脉起于足跟外侧（D错）。冲脉起于小腹内（E错）。